左、右中切牙之间往往有一间隙，待侧切牙萌出，间隙逐渐消失，中切牙位置转为正常
A. 上唇系带位置过低
B. 中切牙间间隙
C. 暂时性远中（牙合）
D. 暂时性前牙拥挤
E. 暂时性深覆（牙合）

正确答案：B。中切牙间间隙

解析：中切牙间间隙：左、右中切牙之间往往有一间隙，待侧切牙萌出，间隙逐渐消失，中切牙位置转为正常。掌握“（牙合）的生长发育”知识点。